下列属于桂枝汤的功效是
A. 发汗祛湿，兼清里热
B. 解肌发表，调和营卫
C. 发汗解表，宣肺平喘
D. 温中补虚，和里缓急
E. 发汗解表，兼清里热

正确答案：B。解肌发表，调和营卫

解析：桂枝汤由桂枝、芍药、甘草、生姜、大枣组成。功效为解肌发表，调和营卫（B对）。方中桂枝助卫阳，通经络，解肌发表而祛在表之风寒，为君药。芍药益阴敛营，为臣药。桂枝、芍药等量配伍，既营卫同治，邪正兼顾，相辅相成；又散中有收，汗中寓补，相反相成。生姜助桂枝散表邪，兼和胃止呕；大枣协芍药补营阴，兼健脾益气。共为佐药。炙甘草调和药性，合桂枝辛甘化阳以实卫，合芍药酸甘化阴以益营，功兼佐使之用。发汗祛湿，兼清里热是九味羌活汤的功效(A错）。发汗解表，宣肺平喘是麻黄汤的功效（C错）。温中补虚，和里缓急是小建中汤的功效（D错）。发汗解表，兼清里热是大青龙汤的功效（E错）。